交感神经支配的肌肉是
A. 上斜肌
B. 下斜肌
C. 外直肌
D. 眼轮匝肌
E. 瞳孔开大肌

正确答案：E。瞳孔开大肌

解析：交感神经支配的肌肉是瞳孔开大肌（E对）。眼外肌是控制眼球运动的横纹肌，每眼各有6条，按其走行方向分直肌和斜肌，直肌4条即上、下、内、外直肌，斜肌两条是上斜肌和下斜肌。其中除外直肌（C错）和上斜肌（A错）分别由展神经和滑车神经支配外，其余均由动眼神经支配（B错）。眼轮匝肌属于面部表情肌，由面神经支配（D错）。